女婴，2个月，口腔黏膜出现白色凝乳状的斑点及斑块可擦拭，基底黏膜发红、啼哭、哺乳困难，应怀疑为
A. 鹅口疮
B. 复发性口腔溃疡
C. 疱疹性龈口炎
D. 球菌性口炎
E. 克隆病

正确答案：A。鹅口疮

解析：本题考查口腔念珠菌病。女婴，2个月，口腔黏膜出现白色凝乳状的斑点及斑块可擦拭，基底黏膜发红、啼哭、哺乳困难，应怀疑为鹅口疮（A对）。鹅口疮病损区黏膜有散在色白如雪的柔软小斑点，可融合为白色或蓝白色丝绒状斑片，患儿烦躁不安、啼哭、哺乳困难，符合该女婴的症状。复发性口腔溃疡（B错）好发于10～30岁，具有周期性、复发性、自限性特征，溃疡灼痛明显，具有“黄红凹痛”的临床特征，即溃疡表面覆盖黄色加假膜、周围有红色晕带、中央凹陷、疼痛明显。疱疹性龈口炎（C错）分为原发性和复发性，原发性以6岁以下儿童多见，尤其是6个月～2岁更多，以出现簇集性小水泡为特征；复发性以成人多见，也是簇集性小水泡。球菌性口炎（D错）表现为黏膜充血，局部糜烂或溃疡，表面覆盖一层灰白色或黄褐色假膜，假膜厚而突出黏膜表面，若擦去假膜，可见溢血的糜烂面。克隆病（E错），即克罗恩病，好发于青中年，患者有反复发作的腹胀、腹泻、肠梗阻为主要症状，口腔黏膜可有线状溃疡或形成肉芽肿、小结节及龈增生。这些病都不符合该女婴的表现。